营养性缺铁性贫血的正确预防措施是
A. 提倡鲜牛奶喂养
B. 提倡母乳喂养
C. 多补充维生素B₁₂
D. 早产儿需早补锌
E. 婴儿奶粉应强化钙剂

正确答案：B。提倡母乳喂养

解析：母乳喂养有诸多优点，其中与本题相关的优点是人乳中铁含量为0.05mg/dl，与牛奶中铁含量相似，但人乳中铁的吸收率（49%）高于牛奶（4%）（B对A错）。缺乏维生素B12引起的是巨幼细胞性贫血（P359）（C错）。锌（D错）和钙（E错）与缺铁性贫血的发病无关。